有关新生儿败血症的叙述，不正确的是
A. 有不吃、不哭、体温不升的三大症状
B. 易并发脑膜炎
C. 可有出血症状
D. 血培养阳性率高
E. 常发生休克

正确答案：D。血培养阳性率高

解析：新生儿败血症有不吃、不哭、体温不升的三大症状，易并发脑膜炎等其他部位炎症，可有出血症状，多数黄疸明显且严重 ，可为唯一表现，常发生休克（ABCE对）。血培养阳性率并不高（D错，为本题正确答案）。